肉豆蔻的炮制方法宜选用
A. 复制
B. 提净
C. 煨法
D. 发芽
E. 制霜

正确答案：C。煨法

解析：本题考查的是药材肉豆蔻的炮制方法。肉豆蔻的炮制方法宜选用煨法（C对）。煨法是将净制或切制后的药物用湿面皮或湿纸包裹，或吸油纸均匀隔层分放，进行加热处理，或将药物与麦麸同置炒制容器内用文火加热至规定程度的方法。煨法的目的：①除去药物中部分挥发性及刺激性成分，从而降低副作用，如肉豆蔻。②增强疗效，如肉豆蔻。③缓和药性，如诃子、葛根。复制法（A错）是将净选后的药物加入一种或数种辅料，按规定操作程序，反复炮制的方法。复制的主要目的：①降低或消除药物的毒性或刺激性，如半夏等。②改变药性，如天南星等。③增强疗效，如白附子等。④矫臭矫味，如紫河车等。提净法（B错）是指某些矿物药，特别是一些可溶性无机盐类药物，经过溶解，过滤，除净杂质后，再进行重结晶，以进一步纯净药物的方法。提净的目的：①使药物纯净，提高疗效。②缓和药性。③降低毒性。发芽法（D错）是将净选后的新鲜成熟的果实或种子，在一定的温度或湿度条件下，促使萌发幼芽的方法。发芽的主要目的是：通过发芽，淀粉被分解为糊精、葡萄糖及果糖，蛋白质被分解成氨基酸，脂肪被分解成甘油和脂肪酸，并产生各种消化酶、维生素，使其具有新的功效，扩大用药品种。制霜法（E错）是指药物经过去油制成松散粉末或析出细小结晶或升华的方法。制霜法根据操作方法的不同分为去油制霜、渗析制霜、升华制霜。去油制霜的目的：①降低毒性，缓和药性。如巴豆，有大毒，泻下作用猛烈，去油制霜后可降低毒性，缓和泻下作用，保证临床用药安全有效。②降低副作用。如柏子仁，其内含柏子仁油，具有滑肠通便之功，体虚便溏患者不宜用，制成霜后，除去了大部分油分，可降低滑肠的副作用。渗析制霜的目的是制造新药，扩大用药品种，增强疗效。如西瓜霜。升华制霜的目的是纯净药物，如砒霜。